男，62岁。进食梗噎1月余。胃镜检查：距门齿30～32cm处食管后壁肿物，黏膜表面破溃，距门齿38～40cm处黏膜粗糙、隆起，两处活检均为高分化鱗癌。心、肺及肝功能正常。未见其他部位转移征象。最佳治疗方案是
A. 二线药物化疗
B. 静脉营养支持
C. 食管癌放射治疗
D. 食管癌根治术
E. 胃造瘘肠内营养

正确答案：D。食管癌根治术

解析：患者老年男性（消化道肿瘤好发人群），进食梗噎1月余（食管癌常见症状）。胃镜检查：距门齿30～32cm处食管后壁肿物，黏膜表面破溃，距门齿38～40cm处黏膜粗糙、隆起，两处活检均为髙分化鳞癌（食管癌诊断金标准）。心、肺及肝功能正常。未见其他部位转移征象（提示无手术禁忌证）。跟据患者病史、临床表现和影像学检查，确诊为食管癌。患者一般情况良好，无手术禁忌证，故首选手术治疗（D对）。食管癌放射治疗（C错）、二线药物化疗（A错）仅作为手术的辅助及补充治疗（P276）。静脉营养支持（B错）及胃造瘘肠内营养（E错）均属于营养支持而非治疗手段。